中度失血性休克患者估计失血量为
A. 500ml 以下
B. 800ml 以下
C. 800 ～1000ml
D. 800～1 600ml
E. 1 000ml 以上

正确答案：D。800～1 600ml

解析：休克是指机体有效循环血容量减少、组织灌注不足，细胞代谢紊乱和功能受损的病理过程，它是一个由多种病因引起的综合征。失血量不足20％有效循环血量，即失血量少于800ml（AB错），患者出现轻度失血性休克的临床表现，如神志清楚伴有痛苦表情、精神紧张、恶心、厌食、尿少、口唇皮肤干燥、皮肤苍白、发凉等不适。当患者失血量达有效循环血量的20％~40％，即失血量800~1600ml（D对CE错）时，患者出现中度失血性休克的临床表现，如神志尚清楚、表情淡漠、皮肤苍白、发冷、血压不稳定或下降、脉搏细数、肢端湿冷等。失血量达有效循环血量40％，即失血量达1600ml时，患者出现重度休克，表现为意识模糊或昏迷、口唇四肢发绀、四肢厥冷、脉搏摸不清、血压测不出、尿少甚至无尿等。